互相尊重、密切合作、互相学习是
A. 处理医患关系的原则
B. 处理医际关系的原则
C. 处理医生与医生关系的原则
D. 处理医生与护士关系的原则
E. 处理医生与医技人员关系的原则

正确答案：B。处理医际关系的原则

解析：医学人际关系，主要包括医务人员与病人之间的“医患关系”、医务人员之间的“医际关系”及医务人员与社会之间的“医社关系”。互相尊重、密切合作、互相学习是处理医际关系的原则（B对）。处理医患关系的原则（A错）是平等交往、一视同仁（P60）。所谓的医际关系，就是在为病人服务的过程中，医疗卫生单位内部所形成的医生与护士、医生与医生、医生与药师、医生与技师、护士与护士、医护人员与行政管理人员及后勤供应人员之间的种种工作关系，医生与医生（C错）、医生与护士（D错）、医生与医技人员（E错）的关系只是医际关系的一部分。